恶阻，口淡，呕吐清涎者，多为
A. 脾胃虚弱
B. 脾虚痰湿
C. 肝胃不和
D. 肝经湿热
E. 肝郁脾虚

正确答案：A。脾胃虚弱

解析：脾胃虚弱，运化失司，水湿内停随胃气上行，或湿聚成痰，故口淡，呕吐清涎多口淡，呕吐清涎（A对）。脾虚痰湿多口中淡腻，呕吐痰涎（B错）。肝胃不和多口苦，呕吐酸水或苦水（C错）。肝经湿热，肝郁脾虚均非恶阻的病证（DE错）。